适宜与乳酶生伍用的药物是
A. 干酵母
B. 磺胺类
C. 抗生素
D. 制酸药
E. 活性炭

正确答案：A。干酵母